冬虫夏草的性状鉴别特征有
A. 虫体似蚕
B. 表面深黄色至黄棕色，有 20～30条环纹
C. 全身有足 10对，以中部 6对明显
D. 子座细长，表面深棕色至棕褐色，质柔韧
E. 气微，味微甘

正确答案：A、B、D。虫体似蚕；表面深黄色至黄棕色，有 20～30条环纹；子座细长，表面深棕色至棕褐色，质柔韧